手足皮肤呈大片状脱皮且无色素沉着的发疹性疾病是
A. 猩红热
B. 麻疹
C. 幼儿急疹
D. 水痘
E. 风疹

正确答案：A。猩红热

解析：猩红热为乙型溶血性链球菌所致，高热、皮肤弥漫充血，上有密集针尖大小皮疹，发热1-2天出疹，出疹时高热、咽峡炎、杨梅舌均为其特征性表现，手足皮肤肿大，片状脱皮且无色素沉着（A对）。麻疹（B错）是发热3~4天后出疹，有色素沉着。幼儿急疹（C错）表现为热退疹出。水痘（D错）多为低热，发热第二天出疹，且皮疹由最初的红色斑疹和丘疹变成透明饱满的水泡。风疹（E错）全身症状轻，高热少见，耳后、枕后淋巴结肿大并触痛。